关于福辛普利性质的说法，正确的有
A. 福辛普利属于巯基类ACE抑制剂
B. 福辛普利属于膦酰基类ACE抑制剂
C. 福辛普利属于二羧基类ACE抑制剂
D. 福辛普利在体内可经肝或肾“双通道”代谢
E. 福辛普利在体内代谢为福辛普利拉而发挥作用

正确答案：B、D、E。福辛普利属于膦酰基类ACE抑制剂；福辛普利在体内可经肝或肾“双通道”代谢；福辛普利在体内代谢为福辛普利拉而发挥作用

解析：本题考查福辛普利。福辛普利属于膦酰基类ACE抑制剂（B对AC错），在体内可经肝或肾“双通道”代谢（D对）；福辛普利为前体药物，代谢为福辛普利拉后药效增强（E对）。